不能用于口腔念珠菌病局部治疗的药物是
A. 西地碘
B. 2%～4%碳酸氢钠
C. 制霉菌素、咪康唑
D. 肤轻松软膏
E. 氯己定漱口液

正确答案：D。肤轻松软膏

解析：本题考查口腔念珠菌病的治疗用药。不能用于口腔念珠菌病局部治疗的药物是肤轻松软膏（D错，为本题正确答案）。口腔念珠菌病的治疗原则为去除诱发因素，积极治疗基础病，必要时辅以支持治疗，其中局部药物治疗的药物有：(1）2%～4%碳酸氢钠（小苏打）溶液（B对）；（2）氯己定（E对）；（3）西地碘（A对）；（4）制霉菌素；（5）咪康唑（C对）。此外，克霉唑霜、酮康唑溶液均可局部应用治疗口腔念珠菌感染。